女，30岁，到县妇幼保健院做孕检，接诊医生发现该患者合并妊娠严重并发症，做出以下决定
A. 基因治疗
B. 终止妊娠
C. 给出指导意见并完善相关检查
D. 指导妊娠和胎儿保健
E. 产前诊断

正确答案：C。给出指导意见并完善相关检查

解析：妊娠严重并发症的患者，接诊医生应该给出指导意见并完善相关检查。